患者，男，46岁。背部皮下肿块，无疼痛，生长缓慢，呈扁平分叶状，质软活动，界线清楚，皮色如常，与皮肤无粘连。其诊断是
A. 脂瘤
B. 骨瘤
C. 肉瘤
D. 气瘤
E. 血瘤

正确答案：C。肉瘤

解析：肉瘤是脂肪组织过度增生而形成的良性肿瘤，相当于西医的脂肪瘤，其特点是软似绵，肿似馒，皮色不变，不紧不宽，如肉之隆起（C对）。脂瘤是皮脂腺中皮脂淤积扩张而形成的肿瘤，瘤中心粗大毛囊小孔中，挤出有臭味的脂浆，是脂瘤独有的特征（A错）。骨瘤是骨组织局限性肿大而形成的肿瘤，特点是疙瘩叠起，坚硬如石，紧贴于骨，推之不移（B错）。气瘤是发于皮肤间的多发性肿瘤，其特点是肿块浮浅柔软而有弹性，宛如气在瘤中，挤压后随手弹起（C错）。血瘤是体表血络扩张，纵横丛案而形成的肿瘤，其特点是病变局部色泽鲜红或暗紫，或呈局限性柔软肿块，边界不清，触之如海绵状。（E错）。